不属于物理灭菌法的是
A. 气体灭菌法
B. 火焰灭菌法
C. 干热空气灭菌法
D. 流通蒸汽灭菌法
E. 热压灭菌法

正确答案：A。气体灭菌法